举重运动员使用后，可短时间内急速降低体重，因此需按兴奋剂管理的药物是
A. 缬沙坦
B. 呋塞米
C. 普萘洛尔
D. 硝苯地平
E. 卡托普利

正确答案：B。呋塞米

解析：本题考查兴奋剂的使用。呋塞米（B对）属于利尿剂，可帮助人在短时间内急速降低体重。普萘洛尔（C错）为β受体阻断剂，有镇静效果。缬沙坦（A错）、硝苯地平（D错）、卡托普利（E错）为降压药，不属于兴奋剂。